女，36岁。发现心脏杂音20余年，心界呈梨形，心尖部可闻及舒张期隆隆样杂音，可闻及开瓣音。与患者临床表现相符的是
A. Graham-Steel杂音
B. 水冲脉
C. 毛细血管搏动征
D. 肝颈静脉回流征
E. 右心房增大

正确答案：A。Graham-Steel杂音

解析：患者中年女性，心脏杂音20余年，心界呈梨形（二尖瓣狭窄常见的心浊音界），心尖部舒张期隆隆样杂音（二尖瓣狭窄特征性的杂音），可闻及开瓣音（提示瓣膜弹性尚好），考虑诊断为二尖瓣狭窄。二尖瓣狭窄患者可引起肺动脉高压，当出现严重肺动脉高压时，由于肺动脉及其瓣环的扩张，导致相对性肺动脉瓣关闭不全，此时可在肺动脉瓣区（胸骨左缘第二肋间）闻及高调叹气样舒张早期杂音，即Graham-Steel杂音（A对）。水冲脉（B错）和毛细血管搏动征（C错）属于周围血管征，是脉压增加引起的，为主动脉瓣关闭不全（P299）的体征。肝颈静脉回流征（D错）和右心房增大（E错）为晚期出现右心衰竭时的体征，也可见于二尖瓣狭窄患者，但一般出现较晚。